SLE患者，服用激素，査体发现左股骨头变平，软骨下塌陷，关节间隙变窄，问病变分期
A. I
B. Ⅱ
C. Ⅲ
D. IV
E. V

正确答案：D。IV

解析：该患者患有SLE，服用激素（股骨头坏死的因素），査体发现左股骨头变平，软骨下塌陷，关节间隙变窄，结合患者的因素和辅助检查，属于股骨头坏死的IV期（D对）。股骨头坏死分为为：I期（软骨下溶解期）：股骨头外形完整，关节间隙正常，股骨头负重区关节软骨下骨质中可见 1~2cm宽的弧形透明带，构成“新月征”, 此为坏死松质骨塌陷并与关节软骨分离的表现。这一征象在诊断股骨头坏死中有重要价值，但易于忽视，读片时应仔细观察（A错）。II 期（股骨头修复期）：股骨头外形完整，关节间隙正常，股骨头负重区关节软骨下骨质密度增高，周围可见点状及斑片状密度减低区及囊性改变，病变周围常见一密度增高的硬化带包绕着上述病变区（B错）。III期（股骨头塌陷期）：股骨头负重区的软骨下骨呈不同程度的变平和塌陷，股骨头失去了圆而光滑的外形，软骨下骨的骨密度增高。关节间隙仍保持正常宽度。Shenton 线基本保持连续(C错)。（P724）E选项不属于股骨头坏死的分期。